患者扭伤踝骨，足不能跖屈，不能内翻，考虑什么损伤
A. 胫前肌腱
B. 胫后肌腱
C. 内侧副韧带
D. 外侧副韧带
E. 腓韧带

正确答案：D。外侧副韧带

解析：外侧副韧带包括距腓前韧带、距腓后韧带和跟腓韧带，患者扭伤踝骨，足不能跖屈，不能内翻，应考虑外侧副韧带损伤（D对）。